男，60岁。胸闷气促2周，查体：吸气时BP85/60mmHg，呼气时BP100/75mmHg，心尖搏动减弱，心界向两侧扩大，心率125次/分，律齐。心音低钝遥远，心脏各瓣膜区未闻及杂音。与上述临床表现相符合的体征是
A. De Musset征
B. Ewart征
C. Corrigan征
D. Quincke征
E. Traube征

正确答案：B。Ewart征

解析：患者老年男性，有胸闷气促症状，查体：吸气时BP85/60mmHg而呼气时BP100/75mmHg（奇脉的典型表现）；心尖搏动减弱、心界向两侧扩大且心音低钝遥远（大量心包积液的典型体征），结合患者的病史和典型体征，该患者考虑为心包积液引起心脏压塞。当心包积液量大时可于左肩胛骨下出现叩浊音，听诊闻及支气管呼吸音，称心包积液征(Ewart征）（B对）。De Musset征（点头征）（A错）是指头部出现与心跳一致的规律性点头样运动；Corrigan征（C错）即水冲脉，指脉搏骤起骤落，犹如潮水涨落；Quincke征（D错）即毛细血管搏动征，指轻压指甲可见甲床随脉搏发白和变红；Traube征（E错）即枪击音，指在股动脉搏动处听到的刺耳音，若出现这四种体征可称为周围血管征阳性，常见于主动脉瓣重度关闭不全、甲状腺功能亢进和严重贫血等，一般少见于心脏压塞患者。